为了减少氯吡格雷诱发的消化道出血，需联合应用的药品是
A. 西酞普兰
B. 依诺肝素
C. 雷尼替丁
D. 阿司匹林
E. 维生素K

正确答案：C。雷尼替丁

解析：本题考查药物的相互作用。为了减少氯吡格雷诱发的消化道出血，需联合应用的药品是雷尼替丁（C对）。西酞普兰（A错）为抗抑郁药，一般不用于消化道出血。依诺肝素（B错）为抗凝药物，禁用于消化道出血。阿司匹林（D错）有抗血小板作用，会诱发消化道出血危险。维生素K（E错）为促凝血药物，不用于消化道出血。